有关眼膏剂的表述，不正确的是
A. 眼膏剂具有疗效持久、能减轻眼睑对眼球摩擦的特点
B. 用于眼外伤的眼膏剂不得加入抑菌剂
C. 眼膏剂成品中不得检验出金黄色葡萄球菌和绿脓杆菌
D. 制备眼膏剂所用的容器与包装材料均应严格灭菌
E. 不溶性药物应先研成细粉并通过1号筛，再制成混悬型眼膏剂

正确答案：E。不溶性药物应先研成细粉并通过1号筛，再制成混悬型眼膏剂

解析：本题考查眼膏剂的特点、质量要求及制备工艺。眼膏剂的制备中，不溶性药物应先研成极细粉并通过9号筛，再制成混悬型眼膏剂（E错，为本题正确答案）。